患者左下后牙因龋充填后3个月，咬合不适，无冷热痛。检查：左下5远中邻（牙合）面左下6近中邻（牙合）面银汞合金充填体相连接，不能分开，且有悬突，牙龈乳头红肿，探出血，叩（±），冷热测同对照牙。该患牙的最佳处理为
A. 用钻将两充填体分开
B. 去除旧充填体，分别重新充填
C. 去除其中之一充填体，重新充填
D. 调（牙合）
E. 去除旧充填体，同时充填。

正确答案：B。去除旧充填体，分别重新充填

解析：患者左下后牙因龋充填后3个月，咬合不适，无冷热痛。检查：左下5远中邻（牙合）面左下6近中邻（牙合）面银汞合金充填体相连接，不能分开，且有悬突，牙龈乳头红肿，探出血，叩（±），冷热测同对照牙。该患牙的最佳处理为去除旧充填体，分别重新充填（B对）。根据病例描述，左下5远中邻（牙合）面左下6近中邻（牙合）面银汞合金充填体相连接，不能分开，且有悬突，龈乳头红肿，探出血，可知该充填体接触点恢复不良，已压迫牙龈，导致牙龈炎症，故应该去除旧充填体，分别重新充填，以恢复良好的接触关系。用钻将两充填体分开之后，因为钻具有一定的宽度，可造成两充填体之间无接触，容易嵌塞食物（A错）。两充填体相连，去除其中之一充填，剩下的一边邻接部位粗糙，很难调磨，且不利于恢复良好的邻接关系（C错）。调牙合主要用于调改充填体的咬合高点（D错）。同时充填会造成充填体相连，无法形成正常的接触，且易形成悬突（E错）。